蛋白质-热能营养不良常见并发的维生素缺乏是
A. 维生素A
B. 维生素B₁
C. 维生素C
D. 维生素D
E. 维生素E

正确答案：A。维生素A

解析：营养不良可有多种维生素及微量元素缺乏，尤以脂溶性维生素A、D缺乏常见。而从临床表现看，维生素D缺乏（D错）时营养不良的症状不明显，维生素D缺乏在恢复期生长发育加快时营养不良的症状才比较突出，因此维生素A缺乏最常见（A对）。